25岁原发不孕，月经周期不规则，妇科检查正常，基础体温呈单相，诊断为
A. 黄体功能不足
B. 无排卵型功血
C. 子宫内膜不规则脱落
D. 有排卵型功血
E. 排卵型功血，月经过多

正确答案：B。无排卵型功血

解析：月经不规则是诊断功血的重要依据之一。基础体温呈单相，这个现象提示了患者无排卵。故本题选B。而黄体功能不足的基础体温是呈双相的，故不选。掌握“功能失调性子宫出血”知识点。